呼吸性酸中毒中，哪一项指标为原发性变化
A. PaC02
B. SB
C. AB
D. BB
E. BE

正确答案：A。PaC02

解析：呼吸性酸中毒中，PaC02（A对）为原发性变化。